治疗胸痹寒凝心脉证应首选
A. 苓甘五味姜辛汤合泻心汤加味
B. 枳实薤白桂枝汤合当归四逆汤加减
C. 猪苓汤合天王补心丹加味
D. 五苓散合桃仁红花煎加味
E. 五味子汤合桃红四物煎加味

正确答案：B。枳实薤白桂枝汤合当归四逆汤加减

解析：胸痹寒凝心脉证的病机为寒邪凝滞心脉，致心阳不振，气机痹阻，不通则痛，故当治宜辛温散寒、宣通心阳，方用散寒通阳的枳实薤白桂枝汤合化瘀通阳的当归四逆汤加减（B对）。苓甘五味姜辛汤功用为温肺化饮；泻心汤功用为清热泻火燥湿（A错）。猪苓汤功用为利水，养阴，清热；天王补心丹功用为功用为滋阴清热，养血安神（C错）。五苓散功用为温阳化气，利湿行水；桃仁红花煎功用为活血化瘀，理气通络（D错）。五味子汤功用为生津止渴，暖精益肾；桃红四物煎功用为养血活血（E错）。